赵某，女，3岁。4天前高烧，2天前退烧，但继发口腔溃疡2天，啼哭，流延，拒食。体检发现患儿全口牙龈红肿，上腭粘膜可见丛集成簇的针头大小透明水疱，部分已破溃为表浅溃疡，广泛分布。本病例最可能的诊断为
A. 手－足－口病
B. 疱疹样口疮
C. 疱疹性龈口炎
D. 鹅口疮
E. 急性坏死性龈口炎

正确答案：C。疱疹性龈口炎

解析：本题考查疱疹性龈口炎的临床表现。此患者3岁，有高烧史，且啼哭，流延，拒食，查体可见上腭黏膜可见丛集成簇的针头大小透明水疱及表浅溃疡，此患者表现符合疱疹性龈口炎（C对）的临床特征。手－足－口病（A错）的皮疹病变可累及手掌、足底、会阴及臀部。疱疹样口疮（B错）好发于成人，反复发作，损害仅限于口腔的非角化黏膜。鹅口疮（D错）病变区可见白色或蓝白色丝绒状斑片，由真菌感染引起。急性坏死性龈口炎（E错）好发于青壮年，以龈乳头及龈缘坏死为其特征，龈缘如虫蚀状。